小儿缺铁性贫血的主要病理基础是
A. 生化乏源
B. 血虚不荣
C. 肌肤失养
D. 阴虚火旺
E. 脾胃失调

正确答案：B。血虚不荣

解析：血液是维持人体生命活动的重要物质，其生化与脾肾心肝功能密切相关。脾胃为后天之本，气血生化之源；心主血，既行血以维持全身各脏腑的正常功能活动，又参与血的生成，肝藏血，与肾同源，血充精足，则肾有所主，肝有所藏，精血可以相互转化。故脾肾心肝功能正常，则血液化生充盈，皮肉筋骨、五脏六腑得以濡养。若先天禀赋不足，后天喂养不当或罹患他病而损伤上述脏腑功能，影响血液化生时，则可导致本病的发生。所以小儿缺铁性贫血的主要病理基础是血虚不荣（B对）。